下列哪种方法不是进针手法
A. 单手进针法
B. 夹持进针法
C. 提捏进针法
D. 舒张进针法
E. 飞针

正确答案：E。飞针

解析：临床常用进针法有单手进针法（A对）、双手进针法、针管进针法。其中常用双手进针法有指切进针法、夹持进针法（B对）、舒张进针法（D对）、提捏进针法（C对）、弹针速刺法。飞针（E错,为本题正确答案）不是进针法，而是行针的辅助手法。